包合物是由主分子和客分子构成的
A. 溶剂化物
B. 分子胶囊
C. 共聚物
D. 低共熔物
E. 化合物

正确答案：B。分子胶囊